女孩，2岁。发热、流涕、咳嗽3天，皮疹6小时。查体：精神萎靡，前额及耳后有浅红色斑丘疹，眼结膜充血，口腔黏膜粗糙，两肺呼吸音粗。最可能的诊断是
A. 麻疹
B. 幼儿急疹
C. 风疹
D. 川崎病
E. 咽结合膜热

正确答案：A。麻疹

解析：2岁患儿（麻疹易感人群），发热、流涕、咳嗽3天（麻疹前驱期症状），皮疹6小时（麻疹出疹期），查体：精神萎靡，前额及耳后有浅红色斑丘疹，眼结膜充血，口腔黏膜粗糙（出现科氏斑），两肺呼吸音粗（麻疹出疹期典型体征），根据患儿的临床表现和体征，最可能的诊断是麻疹（A对）幼儿急疹（B错）突起高热，持续3～5天，上呼吸道症状轻，热退出疹，皮疹散在呈玫瑰色，多位于躯干，1～3天皮疹褪尽，热退出疹为其特点（P67）。风疹（C错）前驱期短，全身症状和呼吸道症状较轻，无麻疹黏膜斑，发热1～2天出疹，皮疹分布以面、颈部、躯干为主，1～2天皮疹消退，无色素沉着和脱屑，常伴耳后、颈部淋巴结肿大（P67）。川崎病（D错）常见持续性发热，体温常达39℃以上，常见双侧结膜充血，口唇潮红，有皲裂或出血，见杨梅样舌，手中呈硬性水肿，手掌和足底早期出现潮红，10天后出现特征性趾端大片状脱皮，出现于甲床皮肤交界处，还有急性非化脓性一过性颈淋巴结肿胀，以前颈部最为显著，发热不久（约1～4日）即出现斑丘疹或多形红斑样皮疹，偶见痱疹样皮疹，多见于躯干部，但无疱疹及结痂，约一周左右消退。咽结合膜热（E错）急性起病，高热、咽部充血，疼痛明显、眼睛发红显著。